外伤后涎瘘的诊断主要通过
A. CT
B. MRI
C. ECT
D. B超
E. 造影

正确答案：E。造影

解析：腮腺造影有助于涎瘘的诊断，如腮腺导管口未萎缩，可从导管口注入造影剂。涎瘘形成较久者，腮腺导管口常萎缩，则可从瘘口注入造影剂。腮腺瘘者可见腺体某处有造影剂外溢，而导管系统显示良好。导管瘘则可见主导管上瘘口处有造影剂外溢，在其后方可见导管扩张，系瘘口处狭窄或继发感染所致。掌握“涎瘘”知识点。